根据《中华人民共和国药品管理法实施条例》的规定，应当自取得《药品经营许可证》之日起30日内，按照规定向药品监督管理部门申请《药品经营质量管理规范》认证的单位是
A. 药品批发企业
B. 药品零售企业
C. 药品批发和零售企业
D. 新开办药品批发和零售企业
E. 新开办医疗机构药房

正确答案：D。新开办药品批发和零售企业

解析：本题考查药品经营企业管理。根据《中华人民共和国药品管理法实施条例》的第十三条规定：新开办药品批发企业和药品零售企业（D对），应当自取得《药品经营许可证》之日起30日内，向发给其《药品经营许可证》的药品监督管理部门或者药品监督管理机构申请《药品经营质量管理规范》认证。受理申请的药品监督管理部门或者药品监督管理机构应当自收到申请之日起3个月内，按照国务院药品监督管理部门的规定，组织对申请认证的药品批发企业或者药品零售企业是否符合《药品经营质量管理规范》进行认证；认证合格的，发给认证证书。